小肠的主要生理功能是
A. 主运化
B. 主通调水道
C. 主受纳
D. 主腐熟水谷
E. 主泌别清浊

正确答案：E。主泌别清浊

解析：运化为脾的生理功能。脾主运化，包括运化水谷精微和运化水湿（A错）。通调水道为肺的生理功能（B错）。受纳为胃的生理功能，胃主受纳水谷（C错）。腐熟水谷为胃的生理功能，胃气将饮食物初步消化，并形成食糜（D错）。泌别清浊为小肠的生理功能（E对）。